创建无烟单位和无烟家庭，属于健康教育与健康促进干预的
A. 教育策略
B. 社会策略
C. 环境策略
D. 资源策略
E. 传播策略

正确答案：C。环境策略